在全面深化行政审批制度改革工作中，国务院决定将行政审批项目的管理层级由省级药品监督管理部门下放到设区的市级药品监督管理部门的行政许可项目有
A. 麻醉药品和第一类精神药品运输证明核发
B. 中药材生产质量管理规范认证
C. 麻醉药品和精神药品邮寄证明核发
D. 药用辅料的注册审批

正确答案：A、C。麻醉药品和第一类精神药品运输证明核发；麻醉药品和精神药品邮寄证明核发

解析：本题考查的是药品行政许可事项。在全面深化行政审批制度改革工作中，国务院决定将行政审批项目的管理层级由省级药品监督管理部门下放到设区的市级药品监督管理部门的行政许可项目有麻醉药品和第一类精神药品运输证明核发（A对）与麻醉药品和精神药品邮寄证明核发（C对）。药品行政许可事项：根据《药品管理法》《药品管理法实施条例》《麻醉药品和精神药品管理条例》等法律、行政法规以及其他设定行政许可的相关法律依据，国家对药品注册、安全监管与稽查设定了一系列行政许可项目。如：药品上市许可，表现形式为颁发药品注册证书；药品生产许可，表现形式为颁发《药品生产许可证》和《医疗机构制剂许可证》；药品经营许可，表现形式为颁发《药品经营许可证》；国务院行政法规确认了执业药师执业许可，表现形式为颁发《执业药师注册证》。按照党中央、国务院关于行政审批制度改革精神，各部委进一步梳理本部门目前保留的行政审批事项，对取消或下放后有利于激发市场主体创造活力、增强经济发展内生动力的行政审批事项，进一步加大取消或下放力度。要改革管理方式，向“负面清单”管理方向迈进，清单之外的事项由市场主体依法自主决定、由社会自律管理或由地方政府及其部门依法审批。要抓紧做好取消和下放管理层级行政审批项目的落实和衔接工作，并切实加强事中事后监管。要继续大力推进行政审批制度改革，使简政放权成为持续的改革行动。要健全监督制约机制，加强对行政审批权运行的监督，不断提高政府管理科学化、规范化水平。按照全面深化行政审批制度改革，进一步简政放权的精神，在药品监管领域中，近些年分批分次全部取消了非行政审批事项，取消了一部分与药品相关的行政审批事项，如新药试行标准转正审批，蛋白同化制剂、肽类激素境外委托生产备案，基本医疗保险定点零售药店资格审查、基本医疗保险定点医疗机构资格审查等。同时，将药品委托生产行政许可，生产第一类中的药品类易制毒化学品审批，蛋白同化制剂、肽类激素进口准许证核发，麻醉药品、第一类精神药品和第二类精神药品原料药定点生产审批等行政审批项目由原食品药品监管总局下放至省级人民政府食品药品监管部门。逐步下放药品生产质量管理规范（GMP）认证（B错）、药品再注册行政许可、不改变药品内在质最的补充申请行政许可至省级食品药品监管局。另外，将第二、三类医疗器械经营许可，药品零售企业经营质量管理规范（GSP）认证，麻醉药品和第一类精神药品运输证明核发，麻醉药品和精神药品邮寄证明核发等行政审批项目的管理层级由省级人民政府食品药品监督管理部门下放到设区的市级人民政府食品药品监督管理部门。